有关卫生服务评价的说法错误的是
A. 卫生服务利用和需求可以用一套指标衡量
B. 卫生服务需要和需求是相同的概念
C. 卫生服务提供大于需求时会导致资源利用不足
D. 等候服务时间长说明供给量不足
E. 控制费用和提高质量是卫生服务评价关注的关键问题

正确答案：B。卫生服务需要和需求是相同的概念